可引起男子乳房女性化和女性体毛增多的是
A. 呋塞米
B. 螺内酯
C. 氢氯噻嗪
D. 氨苯蝶啶
E. 甘露醇

正确答案：B。螺内酯

解析：螺内酯（B对）是醛固酮的竞争性拮抗药，是保钾利尿剂，主要用于治疗与醛固酮升高有关的顽固性水肿和充血性心力衰竭，其久用可引起高血钾，此外还有性激素样副作用，可引起男子乳房女性化和妇女多毛症。呋塞米（A错）（P212）是袢利尿剂，氢氯噻嗪（C错）（P215）是噻嗪类利尿剂，氨苯蝶啶（D错）（P217）是肾小管上皮细胞钠离子通道抑制药，甘露醇（E错）（P218）是渗透性利尿剂，以上利尿剂对性激素均无明显影响，不引起男子乳房女性化和女性体毛增多。